血钾浓度6.5mmol/L，其首要处理措施是
A. 静注10%葡萄糖酸钙
B. 透析治疗
C. 停止一切钾的摄入
D. 快速补液
E. 静注葡萄糖胰岛素液

正确答案：C。停止一切钾的摄入

解析：血钾浓度6.5mmol/L，提示为高钾血症（正常血钾浓度为3.5～5.5mmol/L，超过5.5mmol/L即为高钾血症）。高钾血症有导致病人心搏突然停止的危险，因此一经诊断，应首先立即停止一切钾的摄入（C对），然后再采取其他措施。静注10%葡萄糖酸钙（A错）能缓解K⁺对心肌的毒性作用，但并不是首要处理措施。快速补液（D错）、静注葡萄糖胰岛素液（E错）为停止钾摄入之后的一般措施，能降低血钾浓度。而透析治疗（B错）主要用于一般治疗无法降低血钾或者严重高钾血症病人。